男，60岁，上腹胀隐痛伴有皮肤黄染，食欲不振厌油腻饮食1个月，症状进行性加重，体重减轻5kg，10天前开始出现大便颜色变浅，近2天大便呈陶土样，查体：巩膜明显黄染，肝脾肋下未触及，右肋下缘可触及肿大的胆囊底部，无压痛，实验室检查：血总胆红素340μmol/L.血AFP5ng/ml，最可能的诊断为
A. 胆囊结石
B. 肝门部胆管癌
C. 肝癌
D. 胆总管下段癌
E. 胆总管结石

正确答案：D。胆总管下段癌

解析：患者老年男性，上腹胀隐痛伴有皮肤黄染，食欲不振厌油腻饮食1个月，症状进行性加重，体重减轻5Kg（典型癌症全身表现），10天前开始出现大便颜色变浅，近2天大便呈陶土样（提示胆道阻塞），查体：巩膜明显黄染，肝脾肋下未触及，右肋下缘可触及肿大的胆囊底部（排除肝门部胆管癌）（B错），无压痛，实验室检查：血总胆红素340μmol/L（正常值为1.71～17.1μmol/L，17.1～34.2μmol/L可视为隐性黄疸；34.2～170μmol/L之间为轻度黄疸；170～340μmol/L为中度黄疸；大于340μmol/L则为重度黄疸），血AFP5ng/ml（正常值＜5μg/L，高度提示该患者肝胆癌变），据患者的年龄、病史、临床表现、查体和实验室检查，最可能的诊断为胆总管下段癌（D对）。胆囊结石（P439）（A错）多见于成年人，临床大多无症状，典型症状有胆绞痛、上腹隐痛，极少引起黄疸，即使黄疸也较轻。胆总管结石（P440）（E错）的典型体征为Charcot三联征：腹痛、寒颤高热、黄疸，患者一般无症状，有则急性起病。肝癌（P418）（C错）患者典型的临床表现可能有肝区疼痛、肝大或右上腹肿块，乏力、消瘦等全身及消化道症状，AFP≥400ng/L有提示作用。该患者AFP5ng/ml，提示可能有肝癌，但结合临床表现、查体等，最可能的诊断仍为胆总管下段癌。